阿司匹林中能引起过敏反应的杂质是
A. 醋酸苯酯
B. 水杨酸
C. 乙酰水杨酸酐
D. 乙酰水杨酸苯酯
E. 水杨酸苯酯

正确答案：C。乙酰水杨酸酐